休克时引起血压降低的主要发病机制是：
A. 交感神经系统衰竭
B. 血液中儿茶酚胺含量过低
C. 外周小动脉紧张度下降
D. 微循环障碍致回心血量不足
E. 心功能不全

正确答案：D。微循环障碍致回心血量不足

解析：休克时引起血压降低的主要发病机制是微循环障碍致回心血量不足（D对），从而心排出量减少，动脉血压下降。休克时交感神经兴奋（A错）、血液中儿茶酚胺含量过高（B错）、外周小动脉紧张度上升（C错）都是微循环变化的代偿表现。心功能不全可致血压降低，但不是休克时引起（E错）。